根据五行学说，五色中属木的是
A. 青
B. 赤
C. 黄
D. 白
E. 黑

正确答案：A。青

解析：本题考查事物属性的五行归类，属考试重点。青、（A对）赤、黄、白、黑“五色”分别对应木、火、土、金、水五行 。